《室内空气质量标准》分别作了冬季采暖和夏季空调的量值规定的是
A. 新风量
B. 空气流速
C. 二氧化碳
D. 可吸入颗粒
E. 细菌总数

正确答案：B。空气流速

解析：本题考查《室内空气质量标准》的内容。《室内空气质量标准》分别作了冬季采暖和夏季空调的量值规定的是室内温度、相对湿度和空气流速（B对ACDE错）。其中夏季空调空气流速≤0.3m/s，冬季采暖空气流速≤0.2m/s。